心肌正常收缩的起搏点是
A. 房室束
B. 房室结
C. 窦房结
D. 心房肌
E. 以上都不是

正确答案：C。窦房结

解析：窦房结（C对）为心肌正常收缩的起搏点。